在医务人员的诊治活动中，下列行为符合不伤害原则的是
A. 实施的诊治手段是无益的，但病人也无明显痛苦
B. 实施的诊治手段是不必要的，但可避免医患纠纷
C. 实施的诊治手段有一些不适，但符合适应证
D. 实施的诊治手段对病人有益，但是在强迫下进行的
E. 实施的诊治手段是禁忌的，但是病人要求进行的

正确答案：C。实施的诊治手段有一些不适，但符合适应证